描述S9混合液错误的是
A. 多氯联苯诱导
B. 肝匀浆9000g上清液
C. 为代谢活化系统
D. 含NADP
E. 含葡萄糖

正确答案：E。含葡萄糖